IL-1
A. 作用于体温调节中枢，使体温调定点上移
B. 作用于体温调节中枢，使EP产生和释放
C. 作用于产致热原细胞，使体温调定点上移
D. 作用于产致热原细胞，使EP产生和释放
E. 作用于体温调节中枢和产致热原细胞，使体温调定点上移

正确答案：A。作用于体温调节中枢，使体温调定点上移

解析：IL-1属于EP，EP.作用于体温调节中枢，使体温调定点上移（A对），从而使体温升高。